风湿性心脏病严重二尖瓣狭窄突发大咯血的原因是
A. 肺毛细血管破裂
B. 合并肺结核
C. 急性肺水肿
D. 支气管静脉破裂
E. 合并支气管扩张

正确答案：D。支气管静脉破裂